男，70岁。进行性排尿困难10年，夜尿3～4次。从未药物治疗。直肠指检：前列腺体积增大，中央沟消失，表面尚光滑，质地中等。B超：双肾无积水，输尿管未见扩张。最大尿流率10ml/s。首先考虑的疾病是
A. 膀胱结石
B. 膀胱颈部挛缩
C. 前列腺癌
D. 前列腺增生
E. 神经源性膀胱

正确答案：D。前列腺增生

解析：老年男性患者，进行性排尿困难（前列腺增生典型表现），直肠指检前列腺体积增大，中央沟消失，表面尚光滑，质地中等（提示可能为前列腺增生），结合患者病史、临床表现和相关检查，首先考虑的疾病是前列腺增生（D对）。膀胱结石（A错）典型表现为排尿突然中断，疼痛放射至远端尿道及阴茎头部，伴排尿困难和膀胱刺激症状。膀胱颈部挛缩（P556）（B错）多于40～50岁出现排尿不畅症状，前列腺体积不增大，膀胱镜检查可以确诊。前列腺癌（P572）（C错）直肠指检可发现前列腺结节，质地坚硬。神经源性膀胱（P556）（E错）为动力性梗阻，临床表现与前列腺增生相似，但前列腺不增大，病人常有中枢或周围神经系统损伤的病史和体征。